5岁男孩，高热1天，腹泻6～7次，为黏液性脓血便，腹痛伴里急后重，反复惊厥，逐渐出现昏睡、神志不清，病前吃过未洗的黄瓜，诊断为细菌性痢疾。其临床类型属于
A. 普通型
B. 轻型
C. 重型
D. 中毒型
E. 慢性型

正确答案：D。中毒型

解析：5岁男孩，高热1天，腹泻6～7次，为黏液性脓血便，腹痛伴里急后重，反复惊厥，逐渐出现昏睡、神志不清等符合中毒型菌痢（D对）的临床表现，如：起病急骤，突然高热、反复惊厥、嗜睡、迅速发生休克、昏迷等，多有近期不洁的饮食史如病前吃过未洗的黄瓜，是急性细菌性痢疾的危重型，病死率高，必须积极抢救。而普通型急性菌痢（A错）起病急，有中度毒血症表现，畏寒、发热达39℃、乏力、食欲减退、恶心、呕吐、腹痛、腹泻、里急后重等。稀便转为脓血便，每日数十次，量少，失水不显著。一般病程10～14天，故该患者不考虑此病。轻型急性细菌性痢疾（B错）全身中毒症状、腹痛、里急后重均不明显，可有低热、糊状或水样便，混有少量黏液，无脓血，一般每日10次以下。一般病程3～6天，故该患者不考虑此病。重型急性细菌性痢疾（C错）有严重全身中毒症状及肠道症状。起病急、高热、恶心、呕吐，剧烈腹痛及腹部（尤为左下腹）压痛，里急后重明显，脓血便，便次频繁，甚至失禁。病程进展快，明显失水，四肢发冷，极度衰竭，易发生休克，该患者不考虑此病。慢性菌痢（E错）患者可反复发作或迁延不愈达2个月以上，主要病理变化为结肠溃疡性病变，溃疡边缘可有息肉形成，溃疡愈合后留有瘢痕，导致肠腔狭窄，该患儿为急性起病，故不考虑该病。